既理气消胀，又和胃止痛的中成药是
A. 胃舒片
B. 胃得安片
C. 胃苏颗粒
D. 胃疡灵颗粒
E. 六味安消散

正确答案：C。胃苏颗粒

解析：本题考查的是胃苏颗粒的功能。既理气消胀，又和胃止痛的中成药是胃苏颗粒（C对）。胃苏颗粒：【功能】理气消胀，和胃止痛。六味安消散（E错）：【功能】和胃健脾，消积导滞，活血止痛。胃舒片（A错）、胃得安片（B错）、胃疡灵颗粒（D错）的功能，2022年考试指南未明确说明。